下列关于循证医学的叙述错误的是
A. 循证医学是建立在证据、医务人员实践和患者利益结合之上的
B. 临床研究的可靠证据是循证医学的基石
C. 循证医学不包括医师（或药师）长期积累的临床诊治经验
D. 循证医学要结合具体患者采用有效、合理、实用和经济的治疗方案
E. 循证医学可以使患者得到最佳临床效果和生活质量

正确答案：C。循证医学不包括医师（或药师）长期积累的临床诊治经验

解析：本题考查循证医学。循证医学是在医疗决策中将临床证据、个人经验与患者的实际状况和意愿（A对）三者相结合，是包括医师（或药师）长期积累的临床诊治经验（C错，为本题正确答案）的。循证医学强调任何医疗决策应建立在研究证据基础上（B对）。循证医学评价要结合具体患者采用有效、合理、实用和经济的治疗方案（D对）。循证医学能够使患者得到最佳临床效果和生活质量（E对）。